下列药物制剂中，要求在冷处保存的是
A. 注射用门冬酰胺酶
B. 对乙酰氨基酚片
C. 硫酸阿托品注射液
D. 丙酸倍氯米松气雾剂
E. 红霉素软膏

正确答案：A。注射用门冬酰胺酶

解析：本题考查药品的贮存。要求在冷处保存的是注射用门冬酰胺酶（A对）。注射用门冬酰胺酶系自大肠埃希菌中提取制备的具有酰胺基水解作用的酶，要求遮光、密封、冷处保存。对不耐高温药品，可根据其不同性质要求，分别存放于“阴凉处”“凉暗处”或“冷处”。其中“冷处”指贮藏处温度为2℃～10℃，该贮藏条件通常应用于遇热不稳定的药品。如胰岛素制剂、人血液制品、抗毒素、抗血清、生物制品等。对乙酰氨基酚片（B错）密封保存。硫酸阿托品注射液（C错）易风化，保存时不能受潮，应密封保存。丙酸倍氯米松气雾剂（D错）要求密闭、在凉暗处保存。红霉素软膏（E错）要求密闭，置阴凉干燥处保存。